男，45岁。发现HBsAg阳性10余年，血ALT28g/L，查体肝脏体积增大，巩膜黄染不明显，则现在该病人肝脏所处的病理变化。最可能是
A. 气球样变
B. 脂肪变性
C. 嗜酸性坏死
D. 碎片状坏死
E. 桥接坏死

正确答案：D。碎片状坏死

解析：中年男性患者，发现HBsAg（乙肝表面抗原）阳性10余年，血ALT（谷丙转氨酶，正常值为5-40U/L）28g/L，查体肝脏体积增大，巩膜黄染不明显，考虑诊断为慢性肝炎。慢性肝炎的主要病理变化为碎片状坏死（D对）。气球样变（A错）和嗜酸性坏死（C错）主要见于急性普通型肝炎（P198）。脂肪变性（B错）主要见于慢性肝淤血（P16）。桥接坏死虽然也可见于中度和重度慢性肝炎，但不见于轻度慢性肝炎（E错）。